治疗滴虫阴道炎最常用的药物是
A. 青霉素
B. 甲硝唑
C. 氟哌酸
D. 头孢拉定
E. 制霉菌素

正确答案：B。甲硝唑

解析：因滴虫阴道炎可同时有尿道、尿道旁腺、前庭大腺滴虫感染，治愈此病，需全身用药，主要治疗药物为甲硝唑（B对）及替硝唑。青霉素（A错）主要对革兰氏阳性菌有效。氟哌酸（C错）（诺氟沙星）为第三代喹诺酮类药物，主要对对革兰氏阴性菌有效。头孢拉定（D错）对耐药性金葡菌及其他多种对广谱抗生素耐药的杆菌等有迅速而可靠的杀菌作用。制霉菌素（P250）（E错）主要用于治疗外阴阴道假丝酵母菌病。